大包穴位于腋中线上的
A. 第3肋间隙
B. 第4肋间隙
C. 第5肋间隙
D. 第6肋间隙
E. 第7肋间隙

正确答案：D。第6肋间隙

解析：大包乃脾经之穴位，又为脾之大络，在侧胸部腋中线上的第6肋间隙处（D对，ABCE错）。